配位滴定法使用的滴定液是
A. 氢氧化钠滴定液
B. 硫酸铈滴定液
C. 高氯酸滴定液
D. 碘滴定液
E. 乙二胺四醋酸二钠滴定液

正确答案：E。乙二胺四醋酸二钠滴定液